青年女性，间断发热20天，体温37.8℃～39.3℃，查体面部蝶形红斑，肝脾大，该病的特异性抗体是
A. 抗－SSA
B. 抗－CCP
C. 抗ds-DNA
D. 抗－ANCA
E. 抗－ACA

正确答案：C。抗ds-DNA

解析：青年女性，间断发热20天，体温37.8℃～39.3℃（全身表现），查体面部蝶形红斑（SLE的的典型症状），肝脾大，综合考虑诊断为系统性红斑狼疮，抗ds-DNA（C对）是诊断SLE的特异性抗体，为SLE的标记抗体。